金钱白花蛇的药材性状特征主要有
A. 呈圆盘状，盘径3～6cm，蛇体直径0.2～0.4cm
B. 背部有黑白相间的环纹，白色环纹45～48个
C. 背棱明显突出，背鳞扩大呈六角形
D. 背鳞细密，通身15行，尾下鳞单行
E. 气芳香，味微苦而甘

正确答案：A、B、C、D。呈圆盘状，盘径3～6cm，蛇体直径0.2～0.4cm；背部有黑白相间的环纹，白色环纹45～48个；背棱明显突出，背鳞扩大呈六角形；背鳞细密，通身15行，尾下鳞单行

解析：本题考查的是金钱白花蛇的性状特征。金钱白花蛇的药材性状特征主要有呈圆盘状，盘径3～6cm，蛇体直径0.2～0.4cm（A对）、背部有黑白相间的环纹，白色环纹45～48个（B对）、背棱明显突出，背鳞扩大呈六角形（C对）与背鳞细密，通身15行，尾下鳞单行（D对）。金钱白花蛇：【性状鉴别】药材呈圆盘状，盘径3～6cm，蛇体直径0.2～0.4cm。头盘在中间，尾细，常纳口中，口腔内上颌骨前端有毒沟牙1对，鼻间鳞2片，无颊鳞，上下唇鳞通常各为7片。背部黑色或灰黑色，有白色环纹45～58个，黑白相间，白环纹在背部宽1～2行鳞片，向腹面渐增宽，黑环纹宽3～5行鳞片，背正中明显突起一条脊棱，脊鳞扩大呈六角形，背鳞细密，通身15行，尾下鳞单行。气微腥，味微咸（E错）。